“不可逆性”休克与下列哪项无关？
A. 微循环缺血性缺氧
B. DIC
C. 微循环衰竭
D. 各重要器官功能代谢障碍
E. 严重酸中毒致细胞损伤

正确答案：A。微循环缺血性缺氧

解析：微循环缺血性缺氧（A错，为本题正确答案）是微循环缺血期的微循环变化特点，而不是“不可逆性” 休克（微循环衰竭期）的微循环变化特点。DIC（B对）、微循环衰竭（C对）、各重要器官功能代谢障碍（D对）和严重酸中毒致细胞损伤（E对）都是微循环衰竭期的临床表现。